属于解热镇痛药的是
A. 地西泮
B. 吲哚美辛
C. 硝酸甘油
D. 胺碘酮
E. 阿米卡星

正确答案：B。吲哚美辛

解析：本题考查解热镇痛药。吲哚美辛（B对）为芳基乙酸类非甾体抗炎药，具有抗炎、镇痛、解热作用；地西泮（A错）为苯二氮䓬类镇静催眠药；硝酸甘油（C错）为硝酸酯类抗心绞痛药；胺碘酮（D错）为心血管系统药物，抗心律失常；阿米卡星（E错）为氨基糖苷类抗菌药物。